男，45岁，全身不适，发热、纳差、恶心半个月，既往毒品注射史。查体：全身多处淋巴结肿大，口腔毛状白膜，血白细胞2.5×10⁹/L，尿蛋白（+），首先需要检查的是
A. HIV抗体
B. 登革热病毒抗体
C. 汉坦病毒
D. 乙肝五项
E. 埃博拉病毒

正确答案：A。HIV抗体

解析：中年男性患者，全身不适，发热、纳差、恶心半个月（艾滋病常见表现），既往毒品注射史（艾滋病高危人群）。查体：全身多处淋巴结肿大，口腔毛状白膜（艾滋病典型体征），血白细胞2.5×10⁹/L，尿蛋白（+）（典型血象），结合患者的症状、体征和实验室检查，怀疑诊断为艾滋病，故首先需要检查的是HIV抗体（A对）。登革热病毒抗体（B错）是用于诊断登革热的。汉坦病毒（C错）是用于检查诊断肾综合征出血热的。乙肝五项（D错）是用于检查诊断乙肝的。埃博拉病毒（E错）是用来检查诊断埃博拉的。